运动功能发育的一般规律是
A. 由下而上
B. 由远及近
C. 又细到粗
D. 由多到少
E. 有不协调到协调

正确答案：E。有不协调到协调

解析：小儿运动功能发育的一般规律是：由上而下，由远及近，由不协调到协调，由粗到精细、准确、灵巧。掌握“运动和语言发育”知识点。